益智仁除暖肾固精缩尿、摄唾外，又能
A. 滋阴益肾
B. 燥湿化痰
C. 强筋健骨
D. 明目止泻
E. 温脾止泻

正确答案：E。温脾止泻

解析：本题考查益智仁的功效。益智仁除暖肾固精缩尿、摄唾外，又能温脾止泻（E对）。益智仁【功效】暖肾固精缩尿，温脾止泻摄唾。墨旱莲【功效】滋阴益肾（A错），凉血止血。陈皮【功效】理气调中，燥湿化痰（B错）。仙茅【功效】补肾壮阳，强筋健骨（C错），祛寒除湿。菟丝子【功效】补阳益阴，固精缩尿，明目止泻（D错），安胎，生津。